女，28岁。发现左颈前包块1个月。无多食。易饥、怕热、消瘦。查体：T36.5℃P80次／分。R18次/分，BP120/80mmHg，甲状腺左叶可触及直径约1cm质硬肿物，表面不光滑，颈部未触及肿大淋巴结。肺呼吸音清，未闻及干湿性啰音，心律齐，腹软，无压痛。最有助于确诊的检查是
A. 颈部增强CT
B. 甲状腺核素静态显像
C. 颈部彩色多普勒超声
D. 细针穿刺细胞学检查
E. 血清甲状腺素水平

正确答案：D。细针穿刺细胞学检查

解析：患者发现左颈前包块1个月，查体发现甲状腺左叶触及直径约1cm质硬肿物，表面不光滑，考虑甲状腺癌。确诊即明确肿块性质，首选细针穿刺细胞学检查（D对），准确率达80%以上（五版外科学P343）。CT（A错）、核素扫描（B错）和超声（C错）均为影像学检查，不能明确甲状腺肿块的病理性质。血清甲状腺素水平（E错）也无法明确肿块性质。